麻黄碱
A. 具发汗、平喘作用
B. 具抗菌作用
C. 具镇痛作用
D. 具镇静麻醉作用
E. 具消肿利尿抗肿瘤作用

正确答案：A。具发汗、平喘作用

解析：本题考查的是麻黄的药理作用。麻黄碱具发汗、平喘作用（A对）。麻黄的药理作用：（1）发汗；（2）平喘、镇咳、祛痰；（3）利尿；（4）解热、镇痛、抗炎。具抗菌作用（B错）的是小檗碱。小檗碱具有抗菌、抗病毒、抗毒素、抗腹泻、解热、抗炎、降血糖等作用。具镇痛作用（C错）的是延胡索乙素。延胡索乙素有镇痛、镇静、抗心肌缺血、抗脑缺血、抗血栓等作用。具镇静麻醉作用（D错）的是东莨菪碱。东莨菪碱有解痉镇痛、解有机磷中毒和散瞳作用，还有镇静、麻醉等作用。具消肿利尿抗肿瘤作用（E错）的是苦参碱。苦参总生物碱具有抗肿瘤、抗病原微生物、抗心律失常、解热、抗炎、抗变态反应和调节免疫等作用。